砒石辛热燥烈，毒剧力猛，外用蚀疮去腐，内服除能截疟外，又能
A. 解毒散结
B. 杀虫止痢
C. 劫痰平喘
D. 攻毒敛疮
E. 消肿止痒

正确答案：C。劫痰平喘

解析：本题考查砒石的功效。砒石辛热燥烈，毒剧力猛，外用蚀疮去腐，内服除能截疟外，又能劫痰平喘（C对）。砒石【功效】外用蚀疮去腐；内服劫痰平喘，截疟。玄参【功效】清热凉血，滋阴降火，解毒散结（A错），润肠。大蒜【功效】解毒，消肿，杀虫，止痢（B错）。轻粉【功效】外用杀虫、攻毒、敛疮（D错）；内服祛痰消积，逐水通便。浮萍【功效】发汗解表，透疹止痒，利水消肿（E错）。